检测富含油脂的药材是否泛油变质常用的方法
A. 酸败度
B. 杂质
C. 水分测定
D. 灰分测定
E. 浸出物测定

正确答案：A。酸败度

解析：本题考查的是酸败度检查。检测富含油脂的药材是否泛油变质常用的方法酸败度（A对）。酸败度检查，酸败度是指油脂或含油脂的种子类药材，在贮藏过程中发生复杂的化学变化，产生游离脂肪酸、过氧化物和低分子醛类、酮类等分解产物，因而出现异臭味，影响药材的感观性质和内在质量。酸败度限度制定要与种子药材外观性状或经验鉴别结合起来，以确定上述各值与种子泛油程度有无明显的相关性，具明显相关性的才能制定限度。杂质（B错）是指药材中混存的来源与规定相同，但其性状或部位与规定不符的物质；或来源与规定不同的物质或无机杂质，如砂石、泥土、尘土等。水分测定（C错）中药中含有过量的水分，最容易造成中药霉烂变质，使有效成分分解，且相对减少了实际用量而影响治疗效果，因此，控制中药中的水分含量对保证中药质量有密切关系。灰分测定（D错）测定灰分的目的是限制中药中无机杂质如泥土、沙石的含量，以保证中药的纯度。浸出物测定（E错）包括水溶性、醇溶性及醚溶性浸出物等。